化学药品说明书的格式中包括
A. 性状
B. 功能主治
C. 药理毒理
D. 规格
E. 有效期

正确答案：A、C、D、E。性状；药理毒理；规格；有效期

解析：本题考查药品说明书的格式。化学药品说明书的格式包括：性状（A对）、适应证、药理毒理（C对）、规格（D对）、有效期（E对）。其中化学药品说明书应使用适应证而不是功能主治（B错）。